以下哪一项是体内氨的解毒产物
A. 谷氨酰胺
B. 酪氨酸
C. 谷氨酸
D. 谷胱甘肽
E. 天冬酰胺

正确答案：A。谷氨酰胺

解析：谷氨酰胺是氨的解毒产物，也是氨的储存及运输的形式。掌握“氨基酸及氨的代谢”知识点。